乳牙Ⅱ类洞何种情况下可制备成无台阶形复面洞
A. 乳牙接触点较近牙合面时
B. 乳牙龈缘较近牙合面时
C. 乳牙龋蚀较近牙合面时
D. 乳牙龋蚀及龈缘较近牙合面时
E. 乳牙接触点、龈缘或龋蚀较近牙合面时

正确答案：E。乳牙接触点、龈缘或龋蚀较近牙合面时

解析：本题考查乳牙Ⅱ类洞。当乳牙接触点较近（牙合）面时，为了保护接触点，可制备成Ⅱ类洞形的无台阶复面。乳牙龈缘较近（牙合）面时，为了保护龈缘，防止预备时损伤牙龈，可制备成Ⅱ类洞形的无台阶复面。乳牙龋蚀较近（牙合）面时，龋坏组织少，需要去除的腐质少，洞预备时尽量保留健康的牙体组织。综上得知当乳牙接触点、龈缘或龋蚀较近（牙合）面时（E对）可制备成Ⅱ类洞形的无台阶复面。